WHO规定的青春期的年龄范围是
A. 10～20岁
B. 9～15岁
C. 12～18岁
D. 13～20岁
E. 12～15岁

正确答案：A。10～20岁